在实施三级预防时，重点在第一级预防，同时兼顾二三级预防的疾病是
A. 急性阑尾炎
B. 流行性感冒
C. 食物中毒
D. 冠心病
E. 肺炎

正确答案：D。冠心病

解析：冠心病（D对）是慢性非传染性疾病，重点在第一级预防，也需要同时兼顾二三级预防。三级预防机制中，第一级预防针对的是无病期的健康人群或易感人群，是为了防止或减少疾病发生：第二级预防则是针对疾病的临床前期，无明显表现的早期患者，防止和延缓疾病的发展：第三级预防是针对疾病的临床期或康复期的确诊患者，是为了提高生活质量、延长寿命。急性阑尾炎（A错）、流行性感冒（B错）、食物中毒（C错）、肺炎（E错）四者属于急性疾病，它们的发生有一定的偶然性和紧急性，因此他们的重点应该是在第二、三级预防，主要是为了尽早治疗改善预后。